我国《公共浴室卫生标准》规定就浴者不得患有
A. 心血管疾病
B. 过敏性疾病
C. 性病及传染性皮肤病
D. 消化道疾病
E. 呼吸道疾病

正确答案：C。性病及传染性皮肤病

解析：本题考查《公共浴室卫生标准》。我国《公共浴室卫生标准》规定公共浴室应以淋浴为主，池浴室中应有淋浴喷头。止患有性病和各种传染性皮肤病（C对ABDE错）的顾客就浴。